溃疡性结肠炎病变多发生在
A. 末端回肠
B. 升结肠
C. 降结肠
D. 全结肠
E. 直肠及乙状结肠

正确答案：E。直肠及乙状结肠

解析：溃疡性结肠炎病变多发生在直肠及乙状结肠（E对），也可累及全结肠（D错）甚至末段回肠。末段回肠（A错）是克罗恩病的好发部位（P377）。升结肠（B错）是阿米巴肠炎的好发部位。